分析病因与疾病联系强度的指标是
A. 病死率
B. 缓解率
C. 两者均是
D. 两者均否

正确答案：D。两者均否

解析：本题考查病因与疾病联系强度的指标。在队列研究中，描述病因与疾病联系强度的指标为相对危险度；在病例对照研究中，因为无法计算发病率，无法计算出相对危险度，而是用比值比进行近似代替。病死率和缓解率无法描述病因与疾病的联系强度（D对ABC错）。